治疗血热妄行，应首选
A. 生地
B. 玄参
C. 牡丹皮
D. 赤芍
E. 羚羊角

正确答案：A。生地

解析：生地甘寒，入营血分，善于清解营血分之热而有凉血止血之功，用治血热妄行之吐血、衄血、血热便血、尿血、血热崩漏或产后出血等（A对）。玄参（B错）主治温邪入营，内陷心包，温毒发斑，热病伤阴，舌绛烦渴，津伤便秘，骨蒸劳嗽，目赤，咽痛，瘰疬，白喉，痈肿疮毒。牡丹皮（C错）主治温毒发斑，血热吐衄，温病伤阴，阴虚发热，无汗骨蒸，血滞经闭，痛经，跌打伤痛，痈肿疮毒。赤芍（D错）用于温毒发斑，吐血衄血，目赤肿痛，肝郁胁痛，经闭痛经，癥瘕腹痛，跌仆损伤，痈肿疮疡。羚羊角（E错）主治高热神昏，谵语发狂，惊痫抽搐，目赤肿痛等症。